用一种筛检乳腺癌的试验，对400例患有乳腺癌的妇女和400名正常妇女进行筛检，结果前者中80例阳性，后者中40例阳性。该实验的灵敏度为
A. 0.25
B. 0.12
C. 0.67
D. 0.2
E. 0.8

正确答案：D。0.2

解析：根据表6-2 评价试验的整理表，灵敏度又称为真阳性率，也就是真阳性（a）在病例（a+c）中所占比例，a为真阳性数，即患乳腺癌妇女中的80例阳性结果，C为假阴性数即患乳腺癌妇女中显示阴性的数量，根据灵敏度计算公式可知，该实验的灵敏度=80/400 ×100%=20%（D对），假阴性率=1-灵敏度=80%（E错）。